肝颈静脉回流征不出现于下列哪种疾病
A. 右心衰竭
B. 上腔静脉阻塞综合征
C. 缩窄性心包炎
D. 心包积液
E. 肺心病

正确答案：B。上腔静脉阻塞综合征

解析：肝颈静脉回流征：右心衰竭（A对）或缩窄性心包炎（C对）的病人，如按压其肿大的肝脏时，则颈静脉充盈更为明显，称肝颈静脉回流征。是因右心衰时血量增加，但右心房淤血或右心室舒张受限，不能完全接受回流血量，而致颈静脉充盈更为明显，心包积液（D对）和严重的肺心病患者（E对），也会出现肝颈静脉回流征。而上腔静脉阻塞综合征（B错，为本题正确答案）不涉及下腔静脉的血液动力学改变，只会出现颈静脉充盈、怒张，不会出现肝颈静脉回流征。